臀肌粗隆是
A. 臀大肌的止点
B. 股二头肌的起点
C. 梨状肌的止点
D. 臀中肌的止点
E. 无

正确答案：A。臀大肌的止点

解析：骼胫束、臀肌粗隆是臀大肌的止点（A对）。梨状肌（C错）和臀中肌（D错）的止点是股骨大转子。股二头肌长头的起点是坐骨结节，短头起点是股骨粗线（B错）。